儿童青少年视力低下的诊断标准是
A. 裸眼视力低于4.2
B. 裸眼视力低于4.5
C. 裸眼视力低于4.8
D. 裸眼视力低于5.0
E. 裸眼视力低于5.5

正确答案：D。裸眼视力低于5.0